患者，女，52岁，因“闭经1年，潮热、情绪波动、严重失眠半年”就诊，临床诊断为“更年期综合征”。拟给予的药物治疗方案为：戊酸雌二醇片，每日1次，每次1mg；醋酸甲羟孕酮片，每日1次，每次2mg。应用此方案前，需排除的用药禁忌症为
A. 骨质疏松症
B. 血栓性静脉炎
C. 泌尿系统感染
D. 血脂异常
E. 腰椎间盘突出症

正确答案：B。血栓性静脉炎

解析：本题考查雌激素。应用雌激素可引起高钙血症、水钠潴留、体重增加、三酰甘油升高、糖耐量下降等，并增加血栓性静脉炎（B对）和（或）静脉血栓栓塞性疾病的风险。